充养脑髓、滑利骨节的主要是
A. 精
B. 气
C. 血
D. 津
E. 液

正确答案：E。液

解析：精（A错）具有繁衍生命的重要作用和濡养、化血、化气、化神的功能。气（B错）是构成人体的基本物质之一，是推动和调控脏腑机能活动的动力，起到维系生命进程的作用。血（C错）具有濡养和化神的功能。质地较清稀，流动性较大，布散于体表皮肤、肌肉、孔窍，并能渗入血脉之内，起滋润作用的，称为津（D错）。质地较浓稠，流动性小，灌注于骨节、脏腑、脑、髓等，起濡润作用的，称为液（E对）。